关于炎症，正确的是
A. 炎症反应均对机体有利
B. 任何机体均可发生炎症
C. 炎症是一种防御反应
D. 损伤必然导致炎症
E. 炎症是活体组织的损伤反应

正确答案：C。炎症是一种防御反应

解析：炎症是具有血管系统的活体组织对各种损伤因子的刺激所发生的一种防御反应（C对E错）。并非任何机体均可发生炎症（B错），且损伤也不一定都导致炎症（D错），例如单细胞和多细胞生物对局部损伤发生的反应（包括吞噬损伤因子、通过细胞或细胞器肥大以应对有害刺激等）不能称为炎症。炎症反应对机体既有有利的一面，也有不利的一面（A错），一般来说，变质是对机体不利的损伤性过程，而渗出和增生是对机体有利的修复性过程（P64）。